外来化合物代谢酶的诱导是指
A. 某些化合物可使某些代谢酶活力增强
B. 酶的含量增加
C. 生物转化速度增高
D. 以上都是

正确答案：D。以上都是

解析：本题考查外来化合物代谢酶的诱导。外来化合物代谢酶的诱导是指：某些化合物可使某些代谢酶活力增强；酶的含量增加；生物转化速度增高（D对ABC错）；滑面内质网增生。